属于锥体外系的结构是
A. 豆状核
B. 尾状核
C. 齿状核
D. 脑桥核
E. 以上都是

正确答案：E。以上都是

解析：属于锥体外系的结构有：豆状核（A对）、尾状核（B对）、齿状核（C对）、脑桥核（D对，E为本题正确答案）。还有纹状体、背侧丘脑、底丘脑、中脑顶盖、红核、黑质、脑桥核、前庭核、小脑和脑干网状结构等以及它们的纤维联系。